炮姜的功效是
A. 化瘀止血
B. 收敛止血
C. 凉血止血
D. 温经止血
E. 补气止血

正确答案：D。温经止血

解析：炮姜苦辛温散，入脾、胃、肝经。既善温经止血，为治虚寒出血之要药；又善温中止泻、止痛，为治虚寒腹痛吐泻之佳品（D对）。善化瘀止血（A错）的药有三七、茜草、蒲黄等。善收敛止血（B错）的药有白及、仙鹤草、紫珠叶、棕榈炭等。善凉血止血（C错）的药有大蓟、小蓟、地榆、槐花。